女，65岁。腹部下坠感伴腰酸1年余，发现外阴有脱出肿物6个月。G4P3。妇科查体：患者平卧用力向下屏气时，可见宫颈和部分宫体脱出阴道口。与该病变发生关系最密切的结构是
A. 骶结节韧带
B. 子宫主韧带
C. 子宫圆韧带
D. 子宫阔韧带
E. 卵巢固有韧带

正确答案：B。子宫主韧带

解析：患者老年女性，腹部下坠感伴腰酸，外阴有脱出肿物，平卧用力向下屏气时，可见宫颈和部分宫体脱出阴道口。考虑子宫脱垂。与该病变发生关系最密切的结构是子宫主韧带（B对），因其为固定子宫颈位置、防止子宫脱垂的主要结构。骶结节韧带（A错）、子宫圆韧带（C错）维持子宫前倾位置；子宫阔韧带（D错）限制子宫向两侧倾斜。